固定桥的固位体边缘止于龈上的适应证为
A. 牙冠短，（牙合）龈高度不足
B. 颈部倒凹不大
C. 龈组织健康，龈沟深度正常
D. 龈退缩，牙颈部倒凹大
E. 牙冠有缺损，需要较大的固位力

正确答案：D。龈退缩，牙颈部倒凹大

解析：牙颈部倒凹较大，且牙龈退缩，均为固定桥固位体龈边缘设计为龈上位置的条件。掌握“固定桥的设计”知识点。